有关气雾剂的正确表述是
A. 气雾剂由药物和附加剂、抛射剂、阀门系统三部分组成
B. 气雾剂按分散系统可分为溶液型、混悬型及乳浊型
C. 目前使用的抛射剂为压缩气体
D. 气雾剂只能吸入给药
E. 抛射剂的种类及用量直接影响溶液型气雾剂雾化粒子的大小

正确答案：B、E。气雾剂按分散系统可分为溶液型、混悬型及乳浊型；抛射剂的种类及用量直接影响溶液型气雾剂雾化粒子的大小

解析：本题考查气雾剂。关于气雾剂正确表述：气雾剂按分散系统可分为溶液型、混悬型及乳浊型（B对）；抛射剂的种类及用量直接影响溶液型气雾剂雾化粒子的大小（E对）；气雾剂系指原料药物或原料药和附加剂与适宜的抛射剂共同装封于具有特制阀门系统的耐压容器中，使用时借助抛射剂的压力将内容物呈雾状物喷出，用于肺部吸入或直接喷至腔道黏膜、皮肤的制剂（A错）；气雾剂按分散系统可分为溶液型、混悬型及乳浊型。抛射剂一般可分为氯氟烷烃、氢氟烷烃、碳氢化合物及压缩气体四大类（C错）；按给药途径分类气雾剂可分为吸入气雾剂、非吸入气雾剂及外用气雾剂（D错）。